40岁经产妇，近2年痛经并逐渐加重，伴经量增多及经期延长，届时需服强止痛药。妇科检查：子宫均匀增大如孕8周，质硬，有压痛，经期压痛明显。本例确诊后的处置应选择
A. 镇痛药物治疗
B. 性激素治疗
C. 化学药物治疗
D. 手术治疗
E. 放射治疗

正确答案：D。手术治疗

解析：患者为中年经产妇（子宫腺肌病多发生于30～50岁经产妇）出现进行性加重的痛经，经量增多，经期延长（其主要症状是经量过多、经期延长和逐渐加重的进行性痛经），妇检：子宫均匀增大如孕8周，质硬，有压痛，经期压痛明显（妇科检查子宫呈均匀增大或有局限性结节隆起，质硬且有压痛，经期压痛更甚），应诊断为子宫腺肌病。患者痛经逐渐加重，已服用镇痛药物药物（A错）不能缓解；年龄40岁经产妇，无生育要求，应行手术治疗（D对）。性激素治疗（B错）如达那唑、孕三烯酮或GnRH-a，治疗子宫内膜异位症有效，对子宫腺肌病的症状可缓解但副作用较大，并且停药后症状可复现。化学药物治疗（C错）、放射治疗（E错）用于恶性肿瘤的治疗，对子宫腺肌病无效。